关于桡骨头半脱位时的复位手法正确的是
A. 屈肘90°，前臂旋前、旋后
B. 将患肢抬起，使肘关节置于半屈曲位，沿前壁方向做持续孛引
C. 屈肘约50°，前壁中位站立，沿前壁纵轴牵引
D. Hippocrates法复位
E. Allis法复位

正确答案：A。屈肘90°，前臂旋前、旋后

解析：桡骨头半脱位时手法复位即可，复位时无需麻醉。术者一手握住患儿腕部，另一手托住肘部，以拇指压在桡骨头部位，屈肘90度，前臂旋后、旋前（A对），反复数次，并用拇指轻轻推压桡骨头即可复位。持续牵引（BC错）多用于骨折，不适用于桡骨头半脱位。Hippocrates法（P632）复位（D错）为肩关节脱位的复位方法。Allis法（P655）（E错），即提拉法，为髋关节脱位时常用的复位方法。